黄龙汤煎时“加桔梗一撮”的主要用意是
A. 宣肺化痰止咳
B. 宣肺祛痰利咽
C. 宣肺利气排脓
D. 升提以防正脱
E. 宣肺以助通畅

正确答案：E。宣肺以助通畅

解析：黄龙汤方可攻下热结，益气养血，主治阳明腑实，气血不足证。方中大黄、芒硝、枳实、厚朴（大承气汤）攻下热结，荡涤肠热；当归、人参益气补血、扶正祛邪；桔梗开宣肺气，以助大黄通腑（E对）；姜、枣、草补益脾胃。